女，50岁。活动后胸闷1年，夜间阵发性呼吸困难4天。查体：BP130/80mmHg，P₂亢进，心尖部可闻及舒张期隆隆样杂音，余瓣膜区未闻及杂音。该患者最易出现的心律失常是
A. 三度房室传导阻滞
B. 室上性心动过速
C. 心房扑动
D. 室性心动过速
E. 心房颤动

正确答案：E。心房颤动

解析：患者中年女性，有活动后胸闷、夜间阵发性呼吸困难等症状，查体：P₂亢进（提示肺动脉高压），心尖部可闻及舒张期隆隆样杂音（二尖瓣狭窄特征性杂音），综合患者临床表现和体格检查，患者考虑诊断为二尖瓣狭窄。二尖瓣狭窄患者最易出现的心律失常是心房颤动（E对ABCD错），也是相对早期的常见并发症，可能为患者就诊的首发症状。